执业药师管理的意义包括
A. 药店成本上升，竞争力下降
B. 形成新的药店管理模式
C. 只有严格、有效的管制；才能保证药品质量和药学服务质量
D. 只有执业药师，才能最有效地保障公众用药安全有效
E. 执业药师可以扩大药店的药品销售量

正确答案：B。形成新的药店管理模式